赭石除平肝潜阳，重镇降逆外，又能
A. 制酸止痛
B. 祛风明目
C. 凉血止血
D. 息风止痉
E. 散结解毒

正确答案：C。凉血止血

解析：本题考查的是赭石的功效。赭石除平肝潜阳，重镇降逆外，又能凉血止血（C对）。赭石：【功效】平肝潜阳，重镇降逆，凉血止血。牡蛎：【功效】平肝潜阳，镇惊安神，软坚散结，收敛固涩，制酸止痛（A错）。蒺藜：【功效】平肝，疏肝，祛风明目（B错），散风止痒。全蝎：【功效】息风止痉（D错），攻毒散结，通络止痛（E错）。